以肝细胞膜损害为主的急慢性肝炎患者，宜使用的药物是
A. 葡醛内酯
B. 还原型谷胱甘肽
C. 多烯磷脂酰胆碱
D. 甘草酸二铵
E. 熊去氧胆酸

正确答案：C。多烯磷脂酰胆碱

解析：本题考查多烯磷脂酰胆碱。以肝细胞膜损害为主的急慢性肝炎患者，宜使用的药物是多烯磷脂酰胆碱（C对）；葡醛内酯（A错）进入机体后可与含有羟基或羧基的毒物结合，形成低毒或无毒结合物由尿排出，有保护肝脏及解毒作用；还原型谷胱甘肽（B错）与体内过氧化物和自由基结合，保护细胞中含巯基的蛋白质和酶，参与多种有毒物质解毒反应；甘草酸二铵（D错）在化学结构上与醛固酮的类固醇环相似，可阻碍可的松与醛固酮的灭活，从而发挥类固醇样作用，但无皮质激素的不良反应；熊去氧胆酸（E错）是正常胆汁成分的异构体，可增加胆汁分泌，抑制肝脏胆固醇合成，减少肝脏脂肪，松弛Oddi括约肌，促进胆石溶解和胆汁排出。